下列哪项应考虑为功血
A. 月经过多+进行性痛经
B. 月经周期紊乱+贫血
C. 月经过多+甲低
D. 月经过多+子宫增大不平
E. 月经不调+卵巢囊肿

正确答案：B。月经周期紊乱+贫血

解析：功能性子宫出血，简称功血，是一种常见的妇科疾病。是指异常的子宫出血，经诊查后未发现有全身及生殖器官器质性病变，而是由于神经内分泌系统功能失调所致。常表现为月经周期不规律、经量过多、经期延长或不规则出血。根据排卵与否，通常将功血分为无排卵型及排卵型两大类，前者最为多见，约占80～90％，主要发生在青春期及更年期，后者多见于生育期妇女。A答案是子宫内膜异位症的表现，D答案是子宫增大不平，不是子宫内膜增生，据D答案的描述来看，很可能是子宫肌瘤。CE两个答案没有特异性。掌握“功能失调性子宫出血”知识点。